易引起血糖升高的利尿剂是
A. 依他尼酸
B. 依托塞米
C. 布美他尼
D. 乙酰唑胺
E. 氢氯噻嗪

正确答案：E。氢氯噻嗪

解析：本题考查药物的不良反应。氢氯噻嗪（E对）属噻嗪类利尿剂，大剂量噻嗪类及噻嗪类似物有可能引起胰岛素抵抗、高血糖症，加重糖尿病及减弱口服降糖药的效能，引起血钾降低、血钙升高，血尿素氮、肌酐及尿酸升高。依他尼酸（A错）容易引起耳毒性，且可发生永久性耳聋。由于含有磺酰胺结构，对磺胺过敏者使用呋塞米、布美他尼（C错）和依托塞米（B错）可发生交叉过敏反应。乙酰唑胺（D错）作为磺胺的衍生物，可能会造成骨髓抑制、皮肤毒性、磺胺样肾损害。肾衰竭患者使用后可引起蓄积，造成中枢神经系统毒性。